蒲黄的功效是
A. 止带
B. 利尿通淋
C. 解毒敛疮
D. 消肿生肌
E. 清热生津

正确答案：B。利尿通淋

解析：本题考查的是蒲黄的功效。蒲黄的功效是利尿通淋（B对）。蒲黄：【功效】活血祛瘀，收敛止血，利尿通淋。鸡冠花：【功效】收敛止血，凉血，止带（A错），止痢。地榆：【功效】凉血止血，解毒敛疮（C错）。白及：【功效】收敛止血，消肿生肌（D错）。白茅根：【功效】凉血止血，清热生津（E错），利尿通淋。